苯妥英钠是哪种癫痫发作的首选药物
A. 单纯部分性发作
B. 癫痫大发作
C. 复杂部分性发作
D. 癫痫持续状态
E. 失神小发作

正确答案：B。癫痫大发作

解析：苯妥英钠具有膜稳定作用，可降低细胞膜的兴奋性，使动作电位不易产生，从而阻止病灶高频放电向周围正常脑组织扩散，临床为治疗癫痫大发作（B对）和局限性发作的首选药，对精神运动性发作（复杂部分性发作）（C错）亦有效，但对小发作（失神性发作）（E错）无效。苯妥英钠和卡马西平为强直2004U2-阵挛性发作和单纯部分性发作（A错）单药治疗的首选，5岁以下首选苯巴比妥，而不用苯妥英钠，因苯妥英钠引起小脑综合征在幼儿不易被发现。地西泮属于苯二氮䓬类抗癫痫药，是治疗癫痫持续状态的首选药（D错），静脉注射显效快，且较其他药安全。